下列结构中不属于间脑的是
A. 内侧膝状体
B. 松果体
C. 后连合
D. 外侧膝状体
E. 上丘

正确答案：E。上丘

解析：上丘（E对）不属于间脑，属于中脑的结构。内侧膝状体（A错）、外侧膝状体（D错）属于间脑组成部分之一后丘脑的结构；松果体（B错）、后连合（C错）属于间脑组成部分之一上丘脑的结构。